对于湖泊、水库水的污染调查，与河流污染的调查内容有所不同，最主要的区别是
A. 应对不同污染区进行调查
B. 应对水生生物进行调查
C. 应加强对水体底泥的调查
D. 应加强对人群健康影响的
E. 应进行不同水层的样品采集

正确答案：C。应加强对水体底泥的调查

解析：本题考查水体污染调查。对于湖泊、水库水的污染调查，与河流污染的调查内容有所不同，最主要的区别是应加强对水体底质的调查（C对ABDE错）。底质是指江河、湖泊、水库等水体底部的淤泥，是水体的重要组成部分。底质中有害物质（特别是重金属）含量的垂直分布一般能反映水体污染历史状况。